麻疹见形期首选的方剂是
A. 银翘散
B. 清解透表汤
C. 宣毒发表汤
D. 解肌透疹汤
E. 透疹凉解汤

正确答案：B。清解透表汤

解析：麻疹见形期首选的方剂是清解透表汤，麻疹出疹期，临床以发热起伏如潮，疹随汗出，咳嗽加剧，烦渴，大便干结为特征。麻毒时邪由口鼻而入犯肺、肺卫失宣，麻毒进一步由肺及脾，正气奋起抗争，驱邪外出，麻毒从皮肤透发全身，达于四末，则出现红色斑丘疹，此为出疹期。治法：清热解毒，透疹达邪。选方清解透表汤加减（B对）。幼儿急疹邪郁肺卫证首选的方剂是银翘散（A错）。麻毒时邪由口鼻而入犯肺、肺卫失宣，故见发热、咳嗽、鼻塞、流涕等肺卫之证，此为前驱期选方宣毒发表汤（C错）解肌透痧汤主治痧麻初起，恶寒发热，咽喉肿痛，烦于咽饮，遍体痛，烦闷呕恶（D错）。透疹凉解汤主治风痧（E错）。